临床预防服务的主要内容不包括
A. 化学预防
B. 筛查
C. 健康咨询
D. 免疫接种
E. 药物治疗

正确答案：E。药物治疗

解析：临床预防服务主要是针对健康人和无症状的患者，因此主要采用医务人员在临床工作中能够提供的第一级预防和第二级预防服务，其服务的内容主要有：对求医者的健康咨询（C对）、筛检（B对）、免疫接种（C对）、化学预防（A对）和预防性治疗（E错，为本题正确答案）。